患者，女，16岁，因尿频和尿痛1天就诊，查体：体温37.2℃，耻骨上有轻度压痛。尿常规示：白细胞500/μl，临床考虑急性膀胱炎。患者既往有青霉素过敏史。关于该患者的治疗策略和用药注意事项的说法，错误的是
A. 可经验性用药，用药前送检尿培养
B. 可使用血药浓度和尿药浓度均较高的左氧氟沙星
C. 用药3天，多数患者可治愈
D. 治疗3天症状无改善，应根据尿培养药敏结果调整用药
E. 停药7天后复查尿培养，以明确是否治愈

正确答案：B。可使用血药浓度和尿药浓度均较高的左氧氟沙星

解析：本题考查急性膀胱炎患者用药注意事项。左氧氟沙星属于喹诺酮类药物，喹诺酮类药物禁用于18岁以下人群，该患者16岁，不能使用喹诺酮类药物治疗（B错，为本题正确答案）。急性膀胱炎治疗可经验性用药，用药前送检尿培养（A对）。用药3天，多数患者可治愈（C对），若治疗3天症状无改善，应根据尿培养药敏结果调整用药（D对）。停药7天后复查尿培养，以明确是否治愈（E对）。